治疗产后乳汁不足气血不足证，应首选
A. 健固汤
B. 通乳丹
C. 顺经汤加牛膝
D. 两地汤合二至丸
E. 加味阿胶汤

正确答案：B。通乳丹

解析：产后缺乳气血虚弱证治宜补气养血、佐以通乳，方选通乳丹（B对）。健固汤（A错）补脾气渗湿，主妇人脾虚湿盛，经前泄水。顺经汤（C错）疏肝理气，活血通经；主治室女月水停久，倒行逆上冲眼，红赤生翳。两地汤合二至丸（D错）治疗阴虚月经延长。加味阿胶汤（E错）治疗少阴阴虚火旺证。